当行胃镜检查时，为避免胃镜进入呼吸道，常需嘱患者
A. 做咳嗽运作
B. 发“啊”音
C. 做吞咽动作
D. 深呼吸
E. 转动头部位置

正确答案：C。做吞咽动作

解析：当进行胃镜检查时，嘱患者进行吞咽动作(C对)，可使会厌封闭咽口，避免胃镜进入呼吸道，而做咳嗽动作(A错)、发“啊”音(B错)、深呼吸(D错)都会打开喉口，易导致胃镜进入呼吸道发生危险，而转动头部位置对于是否进入呼吸道无关(E错)。